患儿男，2岁。因低热3周伴盗汗、乏力来诊。其祖母最近发现患肺结核。查体：消瘦，浅表淋巴结轻度肿大，卡疤（+）。门诊做结核菌素（PPD）试验。嘱患儿来院检查PPD试验结果的时间是
A. 12～24小时
B. 24～48小时
C. 48～72小时
D. 72～84小时
E. 84～96小时

正确答案：C。48～72小时